当样本含量n足够大、样本率p和1-p均不接近于零的前提下，样本率和总体率之间、两个样本率之间差异来源的判断可用
A. 标准误检验
B. 方差检验
C. 平均数检验
D. 卡方检验
E. Z检验

正确答案：E。Z检验

解析：当样本含量n足够大、样本率p和1-p均不接近于零的前提下，样本率的分布近似于正态分布，样本率和总体率之间、两个样本率之间差异来源的判断可用Z检验。掌握“分类资料的统计描述与推断”知识点。